遵循“快乐原则”的是
A. 自我
B. 本我
C. 超我
D. 忘我
E. 无我

正确答案：B。本我

解析：“本我”追求生物本能欲望的满足，是人格结构的基础，是人格中的一个永存的成分。“本我”的活动，遵循“快乐原则”。掌握“心理治疗的理论基础”知识点。